主要特征是牙源性上皮和间叶组织同时增殖，但不伴牙本质和釉质形成的是以下哪种肿瘤
A. 牙源性钙化上皮瘤
B. 牙源性钙化囊性瘤
C. 牙源性腺样瘤
D. 成釉细胞纤维瘤
E. 混合性牙瘤

正确答案：D。成釉细胞纤维瘤

解析：成釉细胞纤维瘤主要特征是牙源性上皮和间叶组织同时增殖，但不伴牙本质和釉质形成。掌握“牙源性腺样瘤、成釉细胞纤维瘤”知识点。